胃溃疡诊断最有意义的检查方法是
A. 腹部B超
B. 腹部CT
C. 粪便潜血检查
D. 胃镜
E. 消化道X线钡剂造影

正确答案：D。胃镜

解析：胃镜（D对）为胃溃疡诊断最有意义的检查方法，其目的在于：①确定有无病变、部位及分期；②鉴别良恶性；③治疗效果的评价；④对合并出血者给予止血治疗。腹部B超（A错）、腹部CT（B错）不能观察胃黏膜形态，对诊断胃溃疡无意义。粪便潜血检查（C错）用于了解溃疡有无合并出血。消化道X线钡剂造影（E错）用于胃镜禁忌者、不愿接受胃镜检查者和没有胃镜时，虽能较好地显示胃黏膜形态，诊断胃溃疡，但其效果仍逊于胃镜。